老年患者突然发生寒战、高热、咳嗽、咳痰，痰黏稠，砖红色，胶冻状，引起感染最可能的病原菌是
A. 葡萄球菌
B. 克雷伯杆菌
C. 铜绿假单胞菌
D. 流感嗜血杆菌
E. 嗜肺军团杆菌

正确答案：B。克雷伯杆菌

解析：老年患者，突发寒战高热，咳嗽咳痰，应怀疑肺炎，患者痰液呈砖红色胶冻状（为克雷伯杆菌肺炎的特征性痰液表现），根据其临床表现和体征，应诊断为克雷伯杆菌（B对）感染的肺炎。葡萄球菌（P48）（A错）感染的肺炎多表现为寒战高热，全身毒血症状明显，多为脓血痰。铜绿假单胞菌（C错）感染的肺炎多表现为发热、呼吸困难及脓痰，痰液可呈蓝绿色。流感嗜血杆菌（D错）肺炎好发于婴幼儿，成人及老年人少见，主要表现为发热、咳嗽、咳脓性痰、呼吸急促及发绀等，与患者临床表现不符。嗜肺军团杆菌（E错）肺炎主要表现为高热、寒战、头痛、胸痛、咳黏痰带少量血丝或血痰，痰量少，一般不呈脓性。